某医师在为患者施行右侧乳房肿瘤摘除术时，发现左侧乳房肿块，当即进行活检，确诊为乳腺病。医师判断将来可能癌变，未征求患者意见，同时切除了左侧乳房。医师的这种做法，违背了病人权利的哪一点
A. 平等的医疗权
B. 保密权
C. 隐私权
D. 知情同意权
E. 获得信息权

正确答案：D。知情同意权

解析：知情同意权：知情同意是尊重患者自主性的具体体现，是指在临床过程中，医务人员为患者作出诊断和治疗方案后，应当向患者提供包括诊断结论、治疗决策、病情预后以及诊治费用等方面的真实、充分的信息，尤其是诊疗方案的性质、作用、依据、损伤、风险以及不可预测的意外等情况，使患者或其家属经过深思熟虑自主地作出选择，并以相应的方式表达其接受或者拒绝此种诊疗方案的意愿和承诺。在得到患方明确承诺后，才可最终确定和实施拟定的诊治方案。掌握“医患关系伦理”知识点。